丙药品零售企业从不具有药品经营资质的“背包药贩”处购买“医保回收”的市场紧俏降糖药，并在店内销售。关于丙药品零售企业购进此类药品的行为应当定性为
A. 以销售假药共同犯罪论处
B. 从非法渠道购进药品
C. 以销售劣药共同犯罪论处
D. 向非法渠道销售药品

正确答案：B。从非法渠道购进药品

解析：本题考查的是药品零售经营的禁止类行为。丙药品零售企业从不具有药品经营资质的“背包药贩”处购买“医保回收”的市场紧俏降糖药，并在店内销售。关于丙药品零售企业购进此类药品的行为应当定性为从非法渠道购进药品（B对）。药品零售经营的禁止类禁止类行为：药品零售企业（含药品零售连锁企业门店）在从事药品经营活动中，应当遵循“诚实守信、依法经营”的原则，禁止以任何弄虚作假手段骗取药品经营许可证，尤其是禁止采用聘用“挂证”执业药师骗取药品经营许可证。药品零售企业不得违法回收或参与回收药品，销售回收药品；不得以“远程审方”等方式替代国家对执业药师的配备要求；不得从非法渠道购进药品；不得购进销售医疗机构制剂；不得购进销售假劣药品，或将非药品冒充药品进行宣传、销售；不得以中药材及初加工产品冒充中药饮片销售，非法加工中药饮片；不得销售处方中未注明“生用”的毒性中药品种；不得单味零售罂粟壳；不得出租、出借柜台等为他人非法经营提供便利；不得销售国家明令禁止零售的药品；非定点药品零售企业不得销售第二类精神药品；不得违反规定销售含特殊药品复方制剂（超经营方式、超数量、超频次等），导致流入非法渠道（D错）；不得销售米非司酮（含仅用于紧急避孕或用于治疗子宫肌瘤的米非司酮制剂）等具有终止妊娠作用的药品；不得未经许可擅自改变药品经营许可证许可事项、登记事项；不得购进药品不索取发票（含应税劳务清单）及随货同行单，或虽索取发票等票据，但相关信息（单位、品名、规格、批号、金额、付款流向等）与实际不符；不得违反药品的贮藏要求储存、陈列药品；不得违反国家处方药与非处方药分类管理有关规定销售药品；不得以买药品赠药品等方式向个人消费者销售处方药或甲类非处方药；非本企业在职人员不得在营业场所内从事药学服务活动；不得采取任何手段，诱导个人消费者超出治疗需求购买药品。为生产、销售假、劣药品提供运输、保管、仓储等便利条件的主体应承担的法律责任：根据《药品管理法》规定，知道或者应当知道属于假药、劣药或者124条第一款第一项至第五项的药品，而为其提供储存、运输等便利条件的，没收全部储存、运输收入，并处违法收入一倍以上五倍以下的罚款；情节严重的，并处违法收入五倍以上十五倍以下的罚款；违法收入不足五万元的，按五万元计算。该规定旨在发挥法律的威慑作用，打击与制售假劣药品有关的违法犯罪行为。最高人民法院、最高人民检察院《关于办理危害药品安全刑事案件适用法律若干问题的解释》规定，明知他人生产、销售假药、劣药，而提供生产、经营场所、设备或者运输、储存、保管、邮寄、网络销售渠道等便利条件的，以生产、销售假药、劣药的共同犯罪论处（AC错）。以生产、销售假药、劣药共同犯罪论处的情形还包括：明知他人生产、销售假药、劣药，而提供资金、贷款、账号、发票、证明、许可证件的；或者提供生产技术或者原料、辅料、包装材料、标签、说明书的；或者提供广告宣传等帮助行为的。共同犯罪的，对各共同犯罪人合计判处的罚金应当在生产、销售假药、劣药金额的二倍以上。